患儿生后3天，形体瘦小，全身冰冷，僵卧少动，气息微弱，哭声无力，全身皮肤板硬，苍白肿亮，唇舌淡白。治疗应首选
A. 黄芪桂枝五物汤
B. 参附汤
C. 八珍汤
D. 理中汤
E. 当归四逆汤

正确答案：B。参附汤

解析：患儿全身皮肤板硬，苍白肿亮，属于新生儿硬肿症。其阳气虚衰，失于温煦，故见形体瘦小，全身冰冷，僵卧少动，气息微弱，哭声无力，唇舌淡白，其血脉瘀滞故见全身皮肤板硬。治宜益气温阳，通经活血，方用参附汤（B对）。黄芪桂枝五物汤功能调和营卫，用于汗证之营卫失调（A错）。八珍汤功能补益气血，用于干疳（C错）。理中汤功能温中散寒，可治疗脾胃虚寒证，见自利不渴，呕吐腹痛，腹满不食及中寒霍乱（D错）。当归四逆汤功能温经散寒，活血通络，可用于硬肿症之寒凝血脉（E错）。